一般情况下，要判定食品处于初期腐败阶段，食品中的活菌数需达到
A. 10⁶CFU/g
B. 10⁷CFU/g
C. 10⁸CFU/g
D. 10⁹CFU/g
E. 10¹⁰CFU/g

正确答案：C。10⁸CFU/g

解析：本题考查食品处于初期腐败阶段的判定。一般情况下，要判定食品处于初期腐败阶段，食品中的活菌数需达到10⁸CFU/g（C对ABDE错）。